男孩，10岁。因高度水肿及大量蛋白尿，予泼尼松60mg/d治疗10周，病情未缓解来诊。查体：T36.5℃，P80次/分，R18次/分，颜面明显水肿，面色苍白，肺部未闻及啰音，心（-），腹部较膨隆，肝脾触及不清，四肢明显水肿，实验室检查：蛋白尿（+++），尿沉渣镜检RBC50/HP，肾功能正常。最可能的诊断是
A. 先天性肾病综合征
B. 肾炎性肾病综合征
C. 单纯性肾病综合征
D. 急性肾小球肾炎
E. 慢性肾小球肾炎

正确答案：B。肾炎性肾病综合征

解析：患儿高度水肿及大量蛋白尿，可诊断为肾病综合征（临床有以下4大特点：①大量蛋白尿；②低白蛋白血症；③高脂血症；④明显水肿。以上①、②为必备条件）。由于患儿尿沉渣镜检RBC50/HP（血尿），符合肾炎型肾病综合征的诊断（B对）。单纯型肾病综合征（C错）没有血尿或高血压的症状。先天性肾病综合征（A错），主要的临床特点是出生后（三个月内）即出现符合肾病综合征的临床表现。急性肾小球肾炎（D错）的血蛋白一般正常，仅20%可达到肾病水平，不符合题意。慢性肾小球肾炎（E错）除有肾炎表现外，常由贫血、肾功能异常、低比重尿或固定低比重尿，尿改变以蛋白增多为主。